脑栓塞的常见病因
A. 糖尿病
B. 脑脂肪瘤
C. 动脉粥样硬化
D. 动脉瘤
E. 风湿性心脏瓣膜病

正确答案：E。风湿性心脏瓣膜病

解析：本题考查脑栓塞的病因。脑栓塞的常见病因为风湿性心脏瓣膜病（E对）。脑栓塞是指血液中的各种栓子（如心脏内的附壁血栓、动脉粥样硬化的斑块、脂肪、肿瘤细胞、纤维软骨或空气等）随血流进入脑动脉而阻塞血管，当侧枝循环不能代偿时，引起该动脉供血区脑组织缺血性坏死，出现局灶性神经功能缺损。